我国食品安全标准规定，烧烤或熏制的动物性食品中B（a）P的含量应
A. ≤100μg/kg
B. ≤50μg/kg
C. ≤10μg/kg
D. ≤5μg/kg
E. ≤1μg/kg

正确答案：D。≤5μg/kg

解析：本题考查我国食品安全标准规定的烧烤或熏制的动物性食品中B（a）P的含量。我国食品安全标准规定，烧烤或熏制的动物性食品中B（a）P的含量应≤5μg/kg（D对ABCE错）。